某因素在病因学上与某疾病本无关联，但可引起所研究疾病的症状或体征，从而促使患者及早就诊，提高了早期病例检出率，从而过高的估计了暴露程度，这种偏倚是
A. 诊断怀疑偏倚
B. 检出症候偏倚
C. 测量偏倚
D. 混杂偏倚

正确答案：B。检出症候偏倚

解析：本题考查检出症候偏倚。某因素虽然不是所研究疾病的病因，但有该因素的个体容易出现某些症状或体征，并常因此而就医，从而提高了所研究疾病早期病例的检出率。如果病例对照研究中病例组包括了较多的这种早期病例，致使过高地估计了病例组的暴露程度，而产生的系统误差即为检出症候偏倚（B对ACD错）。